新生儿出生后，监护人应在规定时限为其办理预防接种证，该时限
A. 6个月
B. 1个月
C. 4个月
D. 3个月
E. 2个月

正确答案：B。1个月

解析：新生儿出生后，监护人应在规定时限为其办理预防接种证，该时限为1个月（B对）。